因失眠睡前服用苯巴比妥钠，第二天上午呈现宿醉现象，属于的不良反应种类是
A. 副作用
B. 毒性反应
C. 停药反应
D. 后遗反应
E. 变态反应

正确答案：D。后遗反应

解析：后遗效应是指停药后原血药浓度已降至阈浓度以下而残存的药理效应。前一天晚上服用巴比妥类催眠药后，次日早晨仍有困倦、头晕、乏力等后遗作用，属于后遗效应（D对）。副作用指药物在治疗剂量时与治疗作用同时发生的与治疗目的无关的作用。一般较轻微，多可自行恢复（A错）。毒性反应指药物剂量过大或用药时间过长而引起的机体损害性反应，一般比较严重（B错）。停药反应是指突然停药可出现原有疾病加剧的现象（C错）。变态反应是指少数人对某些药物产生的病理性免疫反应（E错）。